关于低位乳牙，以下不正确的说法是
A. 低位乳牙无法正常替换
B. 低位乳牙好发于上颌第二乳磨牙
C. 外伤可诱发形成低位乳牙
D. 低位乳牙又名乳牙粘连
E. 低位乳牙应及时拔除

正确答案：B。低位乳牙好发于上颌第二乳磨牙

解析：本题考查牙齿固连。关于低位乳牙不正确的是低位乳牙好发于上颌第二乳磨牙（B错，为本题的正确答案）。牙齿固连是牙骨质和牙槽骨的直接结合，固连部位牙周膜丧失，患牙的牙合面低于邻牙正常牙合平面。乳牙比恒牙好发，发生在乳牙的牙齿固连（D对）又名低位乳牙，下牙比上牙好发，恒牙列中最常累及第一恒磨牙。一般发生在乳牙牙根生理性吸收和骨沉积的交替过程中，外伤也可引起低位乳牙（C对）。乳牙列最易受累的牙齿是下颌第一乳磨牙，其次是下颌第二乳磨牙。低位乳牙可发生脱落延迟，无法正常替换（A对），故低位乳牙应及时拔除（E对），保持间隙，为继发恒牙的萌出提供位置。